下列哪个不是儿童多动症的症状表现
A. 注意广度狭窄，抗干扰性差，不能预见行为后果
B. 容易兴奋，缺乏对行为冲动的控制力
C. 多动并伴攻击性行为
D. 与家长、教师和同伴关系不良
E. 营养不良

正确答案：E。营养不良